女性，27岁。产后第4天，出现寒战高热腰痛，尿白细胞30个/HP，尿蛋白（+），并尿痛，下腹痛，肾区叩击痛，耻骨上压痛（+），血象WBC18×10⁹/L，首先应考虑产后并发哪种疾病
A. 产褥热
B. 败血症
C. 上呼吸道感染
D. 急性肾盂肾炎
E. 急性膀胱炎

正确答案：D。急性肾盂肾炎

解析：急性肾盂肾炎的常见临床表现为高热，寒战，腰痛，并伴有尿痛，肾区叩击痛，耻骨上压痛，WBC＞10⁹/L，尿白细胞＞5个/HP，根据患者的临床表现和实验室检查，最可能的诊断是急性肾盂肾炎（D对）。产褥热为产褥期内，出现突然高热寒战，发热持续不退，伴有疼痛、恶露异常、恶心、呕吐等症状，由于患者无以上症状，因此不考虑产褥热（A错）。败血症的常见临床表现为持续高热、寒战、全身明显中毒症状，危及生命，由于患者无以上症状，因此不考虑败血症（B错）。上呼吸道感染的常见临床表现为喷嚏、鼻塞或流清水样鼻涕，咳嗽、咽干、咽痒或灼热感，甚至鼻后滴漏感，由于患者无以上症状，因此不考虑上呼吸道感染（C错）。急性膀胱炎的常见临床表现为明显的尿路刺激征象（尿频、尿急及尿痛），排尿期尿道烧灼感，排尿终末期疼痛加剧，无肾区叩击痛，由于患者无以上症状，因此不考虑急性膀胱炎（E错）。